固有免疫应答是
A. 病原体感染2周后诱导的免疫应答
B. αβT细胞参与的免疫应答
C. 先天具有的、感染早期发生的非特异性免疫应答
D. 进化上不保守的免疫应答
E. 依赖TCR激活的免疫应答

正确答案：C。先天具有的、感染早期发生的非特异性免疫应答